根据临床治疗需要既可炒黄又可炒焦的中药是
A. 山药
B. 枳实
C. 骨碎补
D. 山楂
E. 苍术

正确答案：D。山楂

解析：本题考查的是山楂的炮制方法。根据临床治疗需要既可炒黄又可炒焦的中药是山楂（D对）。山楂：【炮制方法】处方用名有山楂、炒山楂、焦山楂、焦楂、山楂炭。①山楂：取药材，除去杂质及脱落的核及果柄，筛去碎屑。②炒山楂：取净山楂，置炒制容器内，用中火加热，炒至颜色加深，取出晾凉，筛去碎屑。③焦山楂：取净山楂置炒制容器内，用武火加热，炒至外表焦褐色，内部焦黄色，取出晾凉，筛去碎屑。④山楂炭：取净山楂，置炒制容器内，用武火加热，炒至表面焦黑色，内部焦褐色，取出晾凉，筛去碎屑。山药（A错）：【炮制方法】处方用名有山药、怀山药、土炒山药、炒山药。①山药：取原药材，除去杂质，大小分档，洗净，润透，切厚片，干燥，筛去碎屑。②土炒山药：先将灶心土粉置锅内，用中火加热至灵活状态，再投入山药片拌炒，至表面均匀挂土粉时，取出，筛去土粉，放凉。每100kg山药片，用灶心土30kg。③麸炒山药：将锅烧热，撒入麦麸，待其冒烟时，投入山药片，用中火加热，不断翻动至黄色时，取出，筛去麦麸，晾凉。每100kg山药片，用麦麸10kg。枳实（B错）可采用麸炒炮制，以缓和药性。骨碎补（C错）：【炮制方法】处方用名有骨碎补、申姜、制骨碎补、烫骨碎补。①骨碎补：取原药材，除去杂质，洗净，润透，切厚片，干燥。筛去碎屑。②砂炒骨碎补：取砂置炒制容器内，用武火加热至滑利状态，容易翻动时，投入骨碎补片，不断翻动，炒至鼓起，取出，筛去砂，放凉，撞去毛。苍术（E错）：【炮制方法】处方用名有苍术、茅苍术、炒苍术、焦苍术。①苍术：取原药材，除去杂质，用水浸泡，洗净，润透，切厚片，干燥，筛去碎屑。②麸炒苍术：先将锅烧热，撒入麦麸，用中火加热，待冒烟时投入苍术片，不断翻炒，炒至深黄色时，取出，筛去麦麸，放凉。每100kg苍术片，用麦麸10kg。③焦苍术：取苍术片置热锅内，用中火加热，炒至焦褐色时，喷淋少许清水，再用文火炒干，取出放凉，筛去碎屑。